慢性阻塞性肺疾病最常见的并发症不包括
A. 慢性肺源性心脏病
B. 自发性气胸
C. 右心功能不全
D. 支气管扩张
E. 慢性呼吸衰竭

正确答案：D。支气管扩张

解析：慢性阻塞性肺疾病最常见的并发症包括慢性呼吸衰竭（E对）、自发性气胸（B对）以及慢性肺源性心脏病（A对），由于慢阻肺肺脏病变引起肺血管床减少及缺氧致肺动脉收缩、血管重塑，导致肺动脉高压、右心室肥厚扩大，最终发生右心功能不全（C对）。而支气管扩张（P36）（D错，为本题正确答案）大多继发于急、慢性呼吸道感染和支气管阻塞后，反复发生支气管炎症，致使支气管壁结构破坏，引起支气管异常和持久性扩张，主要表现为慢性咳嗽、咯大量浓痰和（或）反复咯血。